肠腔不通同时伴肠壁血运障碍，称为
A. 动力性肠梗阻
B. 血运性肠梗阻
C. 机械性肠梗阻
D. 不完全性肠梗阻
E. 绞窄性肠梗阻

正确答案：E。绞窄性肠梗阻

解析：绞窄性肠梗阻是因肠系膜血管受压、血管内血栓形成、栓子栓塞或肠管高度扩张所引起的肠梗阻的同时伴有肠壁血运障碍疾病（E对）。动力性肠梗阻（A错）是因支配肠道正常运动的神经功能发生障碍，使肠的收缩与舒张功能失常，致肠内容物不能正常运行，但无器质性的肠腔狭窄。血运性肠梗阻（B错）是因肠系膜血管血栓形成或栓塞，引起肠管血循环障碍而发生的肠麻痹，甚至肠坏死或肠穿孔。机械性肠梗阻（C错）是由于肠腔堵塞、肠壁病变、肠管受压等原因使肠腔狭窄，引起肠内容物不能正常顺利通过肠道的疾病。不完全性肠梗阻（D错）是指肠道没有被完全阻塞，仍有部分食物、水、药物通过。